气逆最常见的脏腑是
A. 肺胃肾
B. 肺胃肝
C. 心胃肝
D. 肝肺肾
E. 肝胃肾

正确答案：B。肺胃肝

解析：气逆最常见肺、胃和肝等脏腑（B对ACDE错）。